可诱发超敏反应疾病的微生物是
A. 朊粒
B. 曲霉菌
C. 肺炎衣原体
D. 普氏立克次体
E. 人类免疫缺陷病毒

正确答案：B。曲霉菌

解析：可诱发超敏反应疾病的微生物是曲霉菌（B对）。曲霉菌可诱发过敏性支气管肺曲霉病（一种超敏反应性疾病）。